属于非细胞型微生物的是
A. 钩端螺旋体
B. 人类免疫缺陷病毒
C. 沙眼衣原体
D. 霍乱弧菌
E. 白假丝酵母菌

正确答案：B。人类免疫缺陷病毒

解析：本题考查非细胞型微生物。非细胞型微生物有钩端螺旋体（A对）、沙眼衣原体（C对）、霍乱弧菌（D对）、
白假丝酵母菌（E对）。人类免疫缺陷病毒（B错）不具有细胞结构。